冷脓肿的脓液一般为
A. 淡黄稀薄脓液
B. 翠绿色，稍黏稠，有酸臭味
C. 黄色黏稠脓液
D. 灰白或灰褐色脓液
E. 脓液稀薄污浊，似米汤，夹杂有干酪样坏死物

正确答案：E。脓液稀薄污浊，似米汤，夹杂有干酪样坏死物

解析：冷脓肿的脓液稀薄污浊，暗灰色似米汤，夹杂有干酪样坏死物。掌握“口腔颌面部感染概论”知识点。